治外感风寒，表实无汗，宜选用的饮片是
A. 生麻黄
B. 炙麻黄
C. 炙麻黄绒
D. 麻黄绒
E. 炒麻黄

正确答案：A。生麻黄

解析：本题考查的是生麻黄的作用。治外感风寒，表实无汗，宜选用的饮片是生麻黄（A对）。麻黄：【炮制作用】麻黄味辛、微苦，性温。归肺、膀胱经。具有发汗散寒、宣肺平喘、利水消肿的功能。①生品发汗解表和利水消肿力强。多用于风寒表实证，风水浮肿，风湿痹痛，阴疽，痰核。②蜜麻黄（B错）性温偏润，辛散发汗作用缓和，以宣肺平喘力胜。多用于表证较轻，而肺气壅闭，咳嗽气喘较重的患者。③麻黄绒（D错）作用缓和，适于老人、幼儿及虚人风寒感冒。用法与麻黄相似。④蜜麻黄绒（C错）作用更缓和，适于表证已解而咳喘未愈的老人、幼儿及体虚患者。用法与蜜炙麻黄相似。炒麻黄（E错），2022年考试指南未明确说明。